影响作业能力的主要因素包括
A. 社会和心理因素
B. 个体因素
C. 环境因素
D. 工作条件和性质
E. 以上都是

正确答案：E。以上都是